仅适用于绝经后妇女的骨质疏松症，不适用于男性骨质疏松症的抗骨质疏松药物是
A. 雷洛昔芬
B. 骨化三醇
C. 阿仑膦酸钠
D. 鲑降钙素
E. 唑来膦酸

正确答案：A。雷洛昔芬

解析：本题考查抗骨质疏松药的作用特点。雷洛昔芬（A对）为选择性雌激素受体调节药，临床上主要用于治疗女性绝经后骨质疏松症。